下列是生长发育的调查内容，除了
A. 形态指标
B. 功能指标
C. 素质指标
D. 心理指标
E. 教育指标

正确答案：E。教育指标